评价疫苗接种效果的流行病学指标是
A. 相对危险度
B. 保护率
C. 抗体阳转率
D. 有效率
E. 生存率

正确答案：B。保护率